因阻断黑质-纹状体通路的多巴胺受体，产生锥体外系功能障碍的药物是
A. 利血平
B. 长春新碱
C. 异烟肼
D. 茶碱
E. 氯丙嗪

正确答案：E。氯丙嗪

解析：本题考查药物对机体各系统的毒性作用。因阻断黑质-纹状体通路的多巴胺受体，产生锥体外系功能障碍的药物是氯丙嗪（E对）。抗精神失常药氯丙嗪，阻断中脑-皮质系统通路和中脑-边缘系统通路的多巴胺受体，产生抗精神病作用。而阻断黑质-纹状体通路的多巴胺受体会产生锥体外系功能障碍。早期发现后停药可恢复，后期停药后也难恢复，应用胆碱受体阻断药反而加重。造成迟发性运动障碍的原因可能与氯丙嗪阻断突触后膜多巴胺受体，使多巴胺受体数目增加，受体上调有关。利血平（A错）主要因干扰递质储存，耗竭去甲肾上腺素和多巴胺递质而导致精神抑郁。长春新碱（B错）和秋水仙碱可以与微管蛋白结合，抑制微管蛋白的亚单位形成微管，导致轴突运输的障碍，从而引起周围神经病。异烟肼（C错）导致体内维生素B₆耗竭，GABA合成减少，谷氨酸堆积，引起对中枢和外周神经系统的毒性作用。茶碱（D错）常引起中枢兴奋，儿童大剂量使用可致惊厥。其发生机制是通过作用于相应的G⁻蛋白偶联型受体，激活腺苷酸环化酶，使CAMP产生增多，同时可抑制磷酸二酯酶，从而产生中枢兴奋作用。